治疗子肿脾虚证的代表方剂是
A. 真武汤
B. 白术散
C. 四苓散
D. 鲤鱼汤
E. 天仙藤散

正确答案：B。白术散

解析：子肿脾虚证治宜健脾利水。真武汤功能补肾壮阳，化气利水，为子肿肾虚证的选方（A错）。白术散功能健脾利水，为子肿脾虚证的选方（B对）。四苓散功能健脾渗湿，主治脾胃虚弱，水湿内停证。小便赤少，大便溏泄（C错）。鲤鱼汤功能行水消肿，养血安胎，为子满的选方（D错）。天仙藤散功能理气行滞，除湿消肿，为治疗子肿气滞证的选方（E错）。